最可能影响双侧唇腭裂患者上颌骨发育的是
A. 鼻畸形整复术
B. 腭裂整复术
C. 牙槽突植骨术
D. 正畸矫治器
E. 唇裂整复术

正确答案：B。腭裂整复术

解析：本题考查唇腭裂的修复方法。最可能影响双侧唇腭裂患者上颌骨发育的是腭裂整复术（B对）。随着年龄的增长，多数患者（尤其是腭裂术后）会逐渐出现不同程度的牙颌面继发畸形，特别是上颌与面中份的严重发育不足。因此，腭裂整复术最可能影响双侧唇腭裂患者上颌骨的发育。正畸矫治器（D错）可恢复牙弓形态和改善鼻畸形。鼻畸形整复术（A错）和唇裂整复术（E错）不涉及到骨，为恢复鼻唇形态。牙槽突植骨术（C错）作为唇腭裂序列治疗中的重要步骤，是修补上颌骨裂隙和矫正上颌横向发育不足的有效手段，但不是最可能影响双侧唇腭裂患者上颌骨发育的手术。